发生医疗事故争议时，在医患双方在场的情况下封存的病历资料是
A. 门诊病历
B. 疑难病例讨论记录
C. 医嘱单
D. 特殊检查同意书
E. 住院志

正确答案：B。疑难病例讨论记录

解析：发生医疗事故时，死亡病例讨论记录、疑难病例讨论记录（B对）、上级医师查房记录、会诊记录、病程记录应当在医患双方在场的情况下封存和启封。封存的病例可以是复印件，由医疗机构保管。参考法条：《医疗事故处理条例》第十六条（ACDE错）。